既清热燥湿又清肝明目的是
A. 黄柏
B. 熊胆
C. 牛黄
D. 秦皮
E. 野菊花

正确答案：D。秦皮

解析：本题考查的是秦皮的功效。既清热燥湿又清肝明目的是秦皮（D对）。秦皮：【功效】清热解毒，燥湿止带，清肝明目。黄柏（A错）：【功效】清热燥湿，泻火解毒，退虚热。牛黄（C错）：【功效】清热解毒，息风止痉，化痰开窍。野菊花（E错）：【功效】清热解毒，疏风平肝。熊胆（B错）的功效，2022年考试指南未明确说明。熊胆：【功效】清热解毒，明目，止痉。